以下以金葡菌感染为主的疾病是
A. 急性化脓性腮腺炎
B. 慢性复发性腮腺炎
C. 流行性腮腺炎
D. 舍格伦综合征
E. 腮腺放线菌病

正确答案：A。急性化脓性腮腺炎

解析：本题考查急性化脓性腮腺炎的病因。急性化脓性腮腺炎（A对）的病原菌是葡萄球菌，主要是金黄色葡萄球菌，少数是链球菌，而肺炎双球菌、文森螺旋体少见。慢性复发性腮腺炎（B错）主要表现为腮腺反复肿胀，许多患儿腮腺肿胀发作与上呼吸道感染及口腔内炎性病灶相关，细菌通过腮腺导管逆行感染，其感染菌主要为链球菌。流行性腮腺炎（C错）是由于副黏液病毒感染引起的疾病。舍格伦综合征（D错）是一种自身免疫性疾病，确切病因及发病机制尚不十分明确。腮腺放线菌病（E错）为腮腺的放线菌感染所致。